一50岁男性，吸烟30年，咳嗽伴声音嘶哑3个月，右锁骨上窝触及一个肿大的淋巴结，质硬无压痛。提示该患者的诊断是
A. 喉炎
B. 肺癌
C. 胃癌
D. 鼻咽癌
E. 肺结核

正确答案：B。肺癌

解析：肺癌的早期往往没有任何症状，中年以上经久不愈的咳嗽和血痰，即应提高警惕。本例咳嗽伴声音嘶哑3个月，右锁骨上触及1个肿大质硬无痛性的淋巴结，应首选考虑肺癌，锁骨上淋巴结转移，压迫喉返神经。掌握“肺癌”知识点。